信石的主要化学成分是
A. Na₂SO₄·10H₂O
B. S
C. As₂O₃
D. Fe₂O₃
E. HgS

正确答案：C。As₂O₃

解析：本题考查信石的来源。信石的主要化学成分是As₂O₃（C对）。信石【来源】为天然的砷华矿石、或由毒砂（硫砷铁矿）、雄黄加工制造而成。主要化学成分是As₂O₃。芒硝【来源】为硫酸盐类矿物芒硝族芒硝，经加工精制而成的结晶体。主含含水硫酸钠Na₂SO₄·10H₂O（A错）。硫黄【来源】为自然元素类矿物硫族自然硫；或用含硫矿物经加工制得。主含硫S（B错）。赭石【来源】为氧化物类矿物刚玉族赤铁矿。主含三氧化二Fe₂O₃（D错）。朱砂【来源】为硫化物类矿物辰砂族辰砂。主含硫化汞HgS（E错）。